患儿，女，8岁。手臂部有10余枚半球形丘疹，豌豆大，中央有脐凹，表面有蜡样光泽，挑破顶端可挤压出白色乳酪样物质。其诊断是
A. 寻常疣
B. 脂瘤
C. 传染性软疣
D. 扁平疣
E. 丝状疣

正确答案：C。传染性软疣

解析：传染性软疣，中医称之为鼠乳，多见于儿童，皮损为半球形丘疹，米粒到黄豆、豌豆大小，中央有脐凹，表面有蜡样光泽，挑破顶端可挤压出白色乳酪样物质，数目不定，数个到数十个不等，呈散在性或簇集性分别，好发于躯干和面部，本病例皮疹特点、发病年龄和发病部位与之相符，故诊断为传染性软疣（C对）。寻常疣，中医称之为疣目，多发于儿童及青年，最初为一个针头大至绿豆大的疣状赘生物，呈半球形或多角形，突出表面，色灰白或污黄，表面蓬松枯槁，状如花蕾，粗糙而坚硬，以后体积渐次增大，发展成乳头状赘生物，此为原发性损害，称母堠，此后由于自身接种，数目增多，一般为二三个多则十余个至数十个不等，好发于手背、手指，本病例皮损特点与不符（A错）。脂瘤是皮脂腺中皮脂淤积扩张而形成的肿瘤，好发于头面、耳后、背及臀部等处，瘤体呈圆形，位于皮肤表层内，小如豆粒，大如柑橘，质地柔软，瘤的界限明显，基底可以推动，但表面与皮肤粘连，本病例皮损特点与不符（B错）。扁平疣，中医称之为扁瘊，多发于青年男女，皮损为表面光滑的扁平丘疹，针头、米粒到黄豆大小，呈淡黄色、褐色或正常皮肤颜色，数目很多，散在分布，或簇集成群，有的相互融合，常因搔抓沿表皮剥蚀处发生而形成一串新的损害，本病例皮损特点与不符（D错）。丝状疣，中年妇女较多见，多发生于颈项或眼睑部，皮损为单个细软的丝状突起，呈褐色或淡红色，可自行脱落，不久又可以长出新的皮损，一般无自觉症状，本病例皮损特点与不符（E错）。